以下噬菌体对那种物质比较敏感
A. 红外线
B. 紫外线
C. X射线
D. γ射线
E. β射线

正确答案：B。紫外线

解析：噬菌体的概念：噬菌体是侵袭微生物的病毒，只含有一种核酸DNA或RNA，可感染细菌、真菌、螺旋体和支原体等。噬菌体对理化因素的抵抗力比一般细菌的繁殖体强，一般经75℃30分钟以上，才失去活性，对紫外线敏感。掌握“噬菌体性状及分类”知识点。